治疗流行性脑脊髓膜炎宜选
A. 磺胺嘧啶（SD）+TMP
B. 磺胺甲噁唑（SMZ）+TMP
C. 酞磺胺噻唑（PST）
D. 磺胺醋酰钠（SA）
E. 磺胺嘧啶（SD）+链霉素

正确答案：A。磺胺嘧啶（SD）+TMP

解析：本题考查药物的联合应用。治疗流行性脑脊髓膜炎宜选磺胺嘧啶（SD）+TMP（A对）。磺胺嘧啶（SD）是治疗流行性脑脊髓膜炎的首选药物，甲氧苄啶（TMP）为磺胺类药物的抗菌增效剂，两者合用可增强抗菌疗效。磺胺甲噁唑（SMZ）+TMP（B错）为复方新诺明，主要用于敏感菌株所致的尿路感染、呼吸道感染、小儿急性中耳炎、伤寒和其他沙门菌属感染、肠道感染等。酞磺胺噻唑（PST）（C错）临床用于肠炎、菌痢及肠道术前准备。磺胺醋酰钠（SA）（D错）属于外用磺胺类，临床主要用于沙眼及眼部其他感染的治疗。磺胺嘧啶（SD）+链霉素（E错）（E错）用于治疗鼠疫。